坐骨神经大多数在什么肌的下缘出骨盆
A. 臀小肌
B. 臀中肌
C. 梨状肌
D. 闭孔内肌
E. 臀大肌

正确答案：C。梨状肌

解析：坐骨神经从骶丛发出后，经梨状肌（C对）下孔出盆腔至臀大肌深面，在坐骨结节与大转子连线的中点深面下行到达股后区。